男，75岁。左下肢间歇性跛行3年。疼痛加重1个月。既往高血压病史8年，冠心病病史5年。曾行冠脉支架植入术。查体：BP150/90mmHg。左足苍白，左踝及左下肢皮温明显降低，左足背动脉、动脉搏动消失，左股动脉可触及搏动。可能的诊断是
A. 急性动脉栓塞
B. 血栓闭塞性脉管炎
C. 血栓性浅静脉炎
D. 动脉硬化性闭塞症
E. 深静脉血栓形成

正确答案：D。动脉硬化性闭塞症

解析：老年患者，既往高血压病史、冠心病病史（高危因素），左下肢间歇性跛行（典型表现），疼痛加重，左足苍白，左踝及左下肢皮温明显降低，左足背动脉、动脉搏动消失（缺血），左股动脉可触及搏动（累及动脉），可能的诊断是动脉硬化性闭塞症（D对）。急性动脉栓塞（A错）起病急骤，表现为5P，即疼痛、感觉异常、麻痹、无脉和苍白。血栓闭塞性脉管炎（B错）多侵袭四肢中、小动静脉，以下肢多见，好发于男性青壮年，往往有游走性浅静脉炎病史，不常伴有冠心病、高血压、高脂血症与糖尿病（P490表45-1）。深静脉血栓形成（E错）为静脉疾病，多有下肢肿胀。